工作场所健康教育的本质是
A. 提高职工的健康知识
B. 提高职工的健康功能
C. 传播健康信息
D. 行为改变
E. 提供周到的服务

正确答案：D。行为改变